土壤中大肠菌值大，而产气荚膜杆菌值小时，表示
A. 土壤的污染是陈旧性的
B. 土壤的污染是新近性的
C. 土壤的污染是连续性的
D. 土壤的污染是间断性的
E. 土壤污染还未自净

正确答案：A。土壤的污染是陈旧性的

解析：本题考查土壤的污染。产气荚膜杆菌值是代表粪便污染的指标。因为产气荚膜杆菌可以芽抱的形态在土壤中存活时间比大肠菌长。所以，研究它和大肠菌在土壤中数量的消长关系就可以判定土壤受粪便污染的时间长短。土壤中大肠菌值大，而产气荚膜杆菌值小时，表示土壤的污染是陈旧性的（A对BCDE错）。